关于药物警戒与药物不良反应监测的说法，正确的是
A. 药物警戒和不良反应监测都包括对已上市药品进行安全性评价
B. 药物警戒和不良反应监测的对象都仅限于质量合格的药品
C. 不良反应监测的重点是药物滥用与误用
D. 药物警戒不包括研发阶段的药物安全性评价和动物毒理学评价
E. 药物不良反应监测包括药物上市前的安全性监测

正确答案：A。药物警戒和不良反应监测都包括对已上市药品进行安全性评价

解析：本题考查药物警戒与药物不良反应的异同。药物警戒和不良反应监测都包括对已上市药品进行安全性评价（A对），但区别是药物警戒涵盖了药物从研发直到上市使用的整个过程（D错），而药品不良反应监测仅仅是指药品上市后的监测（E错）。药品不良反应监测对象是质量合格的药品，而药物警戒涉及除质量合格药品之外的其他药物（B错）。药物警戒工作包括药品不良反应监测工作以及其它工作，例如用药失误；缺乏疗效的报告；药品用于无充分科学依据并未经核准的适应证；急性与慢性中毒病例报告；药物相关死亡率的评价；药物滥用与误用（C错）。